氯丙嗪作用机制为
A. 对心肌有奎尼丁样作用
B. 使突触间隙的NA浓度下降
C. 阻断N胆碱受体
D. 阻断D₂样受体
E. 阻断中枢5-HT受体

正确答案：D。阻断D₂样受体